人工自动免疫使用的制剂不包括
A. 脊髓灰质炎活疫苗
B. 丙种球蛋白
C. 卡介苗
D. 麻疹活疫苗
E. 白喉类毒素

正确答案：B。丙种球蛋白

解析：本题考查人工自动免疫使用的制剂。人工自动免疫指采用人工免疫的方法将疫（菌）苗和类毒素等抗原接种到人体，使机体自身的免疫系统产生对相关传染病的特异性免疫力。其使用的制剂包括：①减毒活疫苗：如卡介苗（C对）、脊髓灰质炎疫苗（A对）、麻疹疫苗（D对）等；②灭活疫苗；③类毒素：如白喉类毒素（E对）等；④亚单位疫苗；⑤合成肽疫苗；⑥结合疫苗；⑦基因工程疫苗。丙种球蛋白（B错，为本题正确答案）属于人工被动免疫使用的制剂。